上述各项，属高效消毒法的是
A. 电离辐射
B. 紫外线
C. 超声波
D. 洗手
E. 碘类消毒

正确答案：B。紫外线

解析：高效消毒法可杀灭包括分枝杆菌、病毒、真菌、细菌芽胞在内的微生物，如紫外线（B对）、过氧化氢、臭氧及含氯类消毒剂等。电离辐射属于灭菌法（A错）。超声波、碘类消毒法属于中效消毒法（CE错）。洗手属于低效消毒法（D错）。